有关学习医学伦理学的意义说法错误的是
A. 有利于医务人员的自我完善
B. 有利于实现医疗质量的提高
C. 有利于医务人员解决医德难题
D. 有利于医药卫生单位的精神文明建设
E. 有利于医务人员个人利益的实现

正确答案：E。有利于医务人员个人利益的实现

解析：学习医学伦理学的意义：1)有利于医务人员的自我完善及培养德才兼备的医学人才；2)有利于医务人员实现技术与伦理的统一，实现医疗质量的提高；3)有利于医务人员解决医德难题及促进医学科学的发展；4)有利于医药卫生单位及社会的精神文明建设。掌握“医学伦理学”知识点。